铁粒幼红细胞性贫血
A. 大细胞性贫血
B. 正细胞性贫血
C. 单纯小细胞性贫血
D. 小细胞低色素性贫血
E. 造血不良性贫血

正确答案：D。小细胞低色素性贫血

解析：本题考查铁粒幼红细胞性贫血的相关内容。铁粒幼红细胞性贫血属于小细胞低色素性贫血（D对ABCE错）。由不同原因引起的血红素合成障碍和铁利用不足引起的一组异质性疾病，以骨髓中出现圆形铁颗粒细胞、无效红细胞生成和血清及组织铁水平增加为特征，其表现为小细胞色素减退性贫血，遗传性铁粒幼细胞性贫血多为男性，获得性铁粒幼细胞性贫血在50岁以上常见。